从母体带来的铁可使用的时间是
A. 1～2周
B. 3～4周
C. 1～2个月
D. 3～4个月
E. 5～6个月

正确答案：D。3～4个月

解析：本题考查婴儿喂养方式的相关内容。铁由肠道吸收，是血红蛋白的重要成分，也是造血的活性元素。足月出生的宝宝从母体带来的铁只能维持出生后3～4个月（D对ABCE错）对铁的需求，此后的铁必须从外界补充。